男，38岁，间歇性浮肿10余年，伴恶心呕1周。血压155/110mmHg。血常规Hb80g/L。尿常规：尿蛋白（++），颗粒管型2～3个/HP。血Scr485umnol/L。原发病的诊断可能是
A. 隐匿性肾炎
B. 原发性高血压病
C. 慢性肾盂肾炎
D. 慢性肾小球肾炎
E. 肾病综合征

正确答案：D。慢性肾小球肾炎

解析：中年男性患者，间歇性浮肿10余年（考虑为水、钠潴留引起），伴恶心、呕吐1周，血压155/110mmHg（正常值为90～130/60～90mmHg，提示有高血压）。血常规Hb80g/L（正常120～160g/L，提示有贫血）。尿常规：尿蛋白（++）（正常为阴性，提示有蛋白尿），颗粒管型2～3个/HP（正常为阴性，提示有管型尿）。血Cr485umol/L（正常为88.4～176.8umol/L，提示血肌酐升高）。综合患者的临床表现、实验室检查，考虑诊断为慢性肾衰竭，慢性肾衰竭最常见的病因为慢性肾小球肾炎。因此，原发病的诊断可能是慢性肾小球肾炎（D对）。隐匿性肾炎（A错）一般无水肿、高血压及肾功能损害，仅表现为肾小球源性血尿或（和）蛋白尿（P477）。原发性高血压病（B错）好发于老年人，多有长期高血压病史，肾脏损害及肾功能减退较轻（P250）。慢性肾盂肾炎（C错）常有急性肾盂肾炎病史（发热、腰痛、膀胱刺激征），后出现不同程度的低热、间歇性尿频、腰部酸痛及肾小管功能受损，如夜尿增多、低比重尿等（P493）。肾病综合征常表现为大量蛋白尿（＞3.5g/d）、低白蛋白血症（＜30g/L），伴（不伴）水肿和高脂血症等（P470）。